接触氯乙烯单体的工人中好发
A. 肝血管肉瘤
B. 膀胱癌
C. 胃癌
D. 肺癌
E. 肝癌

正确答案：A。肝血管肉瘤

解析：本题考查氯乙烯的致癌种类。肝血管肉瘤是一种极其罕见又很难诊断的高度恶性肝肿瘤，职业性肝血管肉瘤（A对BCDE错）主要与接触氯乙烯有关，多见于接触高浓度氯乙烯的清釜工。氯乙烯所致肝血管肉瘤诊断细则：①原发性肝血管肉瘤诊断明确；②有明确的氯乙烯单体职业暴露史，氯乙烯单体累计暴露年限1年以上（含1年）；③潜隐期1年以上（含1年）。